脾主运化是指
A. 把水谷化为精微
B. 将精微物质布散全身
C. 二者均有
D. 二者均无

正确答案：C。二者均有

解析：本题考查的是脾的生理功能。脾主运化是指把水谷化为精微与将精微物质布散全身（C对）。脾主运化：（1）运化水谷精微：是指脾对饮食物的消化和水谷精微的吸收、转输、布散的作用。饮食物由胃受纳腐熟，必须依赖于脾的运化功能，才能将水谷转化为精微物质，转输到心肺，布散于全身，从而使各个脏腑、组织、器官得到充足的营养，并通过心肺的作用化生气血，故“脾为后天之本，气血生化之源”。脾气的运化功能正常，称为“脾气健运”减退；其失常，称为“脾失健运”，则可影响饮食物的消化和精微的吸收而出现腹胀、便溏、食欲不振，乃至倦怠、消瘦等精气血生化不足的病变。（2）运化水液：是指脾对水液的吸收、转输和布散作用。水饮的消化吸收亦在胃、小肠和大肠中进行，但又必须经脾气的推动、激发作用，才能完成。脾气转输津液，上输于肺，通过肺气宣降输布全身；并“以灌四傍”，向四周布散，发挥其滋养濡润脏腑的作用。脾气健运，津液化生充足，输布正常，脏腑形体官窍得养。脾失健运，或津液生成不足，或津液输布障碍，而见水湿痰饮等。如《素问·至真要大论》说：“诸湿肿满，皆属于脾。”